治疗耳聋虚证，应选用以上哪组腧穴为主
A. 合谷、神门、翳风
B. 百会、耳门、风池
C. 太溪、照海、听宫
D. 翳风、听会、中渚
E. 太冲、耳门、听宫

正确答案：C。太溪、照海、听宫

解析：《医林绳墨·耳》：“耳属少阴肾经，肾之窍也。肾气实，则耳聪；肾气虚，则耳聋。”肾精不足，无以上荣于耳窍，为耳聋虚证之主要病机。听宫为手太阳经与手、足少阳经之交会穴，气通耳内，具有聪耳启闭之功，为治耳疾要穴，配手少阳经局部的翳风穴，可疏导少阳经气，宣通耳窍。太溪能补肾填精，上荣耳窍。照海为足少阴经和阴跷脉之会，既主一身左右之阴，又可疏通足少阴肾经。诸穴合用，可治肾精亏虚之耳聋（C对）。